药物通过口服、注射或局部涂搽、含漱等不同途径进入体内，使过敏体质者发生变态反应而引起的口腔黏膜及皮肤的超敏反应性疾病，称为
A. 过敏性接触性口炎
B. 药物过敏性口炎
C. 口腔溃疡
D. 固定性药疹
E. 营养不良性口炎

正确答案：B。药物过敏性口炎

解析：药物过敏性口炎是药物通过口服、注射或局部涂搽、含漱等不同途径进入体内，使过敏体质者发生变态反应而引起的口腔黏膜及皮肤的超敏反应性疾病。掌握“常见口腔过敏反应性疾病”知识点。